除了牙齿移位外，成人牙周炎晚期常出现的伴发症状是
A. 食物嵌塞
B. 继发性创伤
C. 急性牙周脓肿
D. 逆行性牙髓炎
E. 以上均是

正确答案：E。以上均是

解析：本题考查成人牙周炎晚期常出现的伴发症状。成人牙周炎在新分类法中归为慢性牙周炎。慢性牙周炎患者主要特征为牙周袋形成、牙龈炎症、牙周附着丧失、牙槽骨吸收，晚期患者因牙槽骨的吸收可伴发牙齿移位继而导致食物嵌塞（A对）、继发性咬合创伤（B对）。晚期患者因深牙周袋内炎症的长期存在可导致急性牙周脓肿（C对）、逆行性牙髓炎（D对）等症状 。（ABCD均对，故E为本题的正确答案）。